用配位滴定法测定硫酸锌含量时，所使用的指示剂是
A. 甲基红
B. 酚酞
C. 淀粉
D. 铬酸钾
E. 铬黑T

正确答案：E。铬黑T